金花消痤丸除消热泻火外，又能
A. 活血止血
B. 解毒消肿
C. 清热燥湿
D. 清热凉血
E. 凉血祛湿

正确答案：B。解毒消肿

解析：本题考查的是金花消痤丸的功能。金花消痤丸除消热泻火外，又能解毒消肿（B对）。金花消痤丸功能：清热泻火，解毒消肿。用于肺胃热盛所致的痤疮，粉刺，口舌生疮，胃火牙痛，咽喉肿痛，目赤，便秘，尿黄赤。地锦草【功效】清热解毒，活血止血（A错），利湿退黄。马应龙麝香痔疮膏【功能】清热燥湿（C错），活血消肿，祛腐生肌。消银颗粒【功能】清热凉血（D错），养血润肤，祛风止痒。当归苦参丸功能：凉血，祛湿（E错）。